根据《医疗机构制剂配制监督管理办法（试行）》，不属于食品药品监督管理部门核准的《医疗机构制剂许可证》许可事项是
A. 制剂室负责人
B. 药学部门负责人
C. 有效期限
D. 配制地址
E. 配制范围

正确答案：B。药学部门负责人

解析：本题考查医疗机构制剂许可证管理。根据《医疗机构制剂配制监督管理办法（试行）》，不属于食品药品监督管理部门核准的《医疗机构制剂许可证》许可事项是药学部门负责人（B错，为本题正确答案）。《医疗机构制剂配制监督管理办法（试行）》第十六条规定，《医疗机构制剂许可证》是医疗机构配制制剂的法定凭证，应当载明证号、医疗机构名称、医疗机构类别、法定代表人、制剂室负责人、配制范围、注册地址、配制地址、发证机关、发证日期、有效期限等项目。其中由（食品）药品监督管理部门核准的许可事项为：制剂室负责人（A对）、配制地址（D对）、配制范围（E对）、有效期限（C对）。